宫颈脱落细胞筛检宫颈癌属于
A. 一级预防
B. 二级预防
C. 三级预防
D. 个体治疗
E. 社区综合防治

正确答案：B。二级预防